成分输血的优点不包括
A. 容易制备
B. 疗效好
C. 纯度高
D. 便于保存
E. 保护血液资源

正确答案：A。容易制备

解析：成分血的制备较为复杂（A错，为本题正确答案）。成分输血有利于根据不同的血液成分，设置不同的保存条件（D对）。相同容量的成分血中有效成分更多，即纯度和浓度更高（C对），如浓缩红细胞、血小板制剂、血浆等，一方面可以提高疗效（B对），另一方面可以保护血液资源（E对）。